女，34岁。月经稀发2年，闭经半年，溢乳3个月。对诊断最有价值的测定项目是
A. hCG
B. 雄激素
C. 雌激素
D. 孕激素
E. PRL

正确答案：E。PRL

解析：患者为年轻女性，月经稀发2年（高催乳素血症的常见临床表现为月经紊乱），闭经半年，溢乳3个月（闭经泌乳是本病的特征之一），考虑为高催乳素血症，对诊断最有价值的测定项目是PRL（血清催乳素），当PRL（E对）＞1.14nmol/L（25µg/L）可确诊为高催乳素血症。hCG（P426）（A错）可提示早期妊娠或滋养细胞肿瘤如葡萄胎、恶性葡萄胎、绒毛膜上皮癌及睾丸畸胎瘤，还对非妊娠性卵巢绒癌有特异性。雌激素测定（P423）（C错）主要用于监测卵巢功能和胎儿-胎盘单位功能。孕激素测定（P424）（D错）主要用于排卵监测、评价黄体功能、辅助诊断异位妊娠和先兆流产、观察胎盘功能、孕酮替代疗法的监测。雄激素测定（P425）（B错）主要用于卵巢男性化肿瘤、多囊卵巢综合症、肾上腺皮质增生或肿瘤等疾病的诊断。